脉象的产生，与什么有关
A. 心脏的搏动
B. 心气的盛衰
C. 脉管的通利
D. 气血的盈亏及各脏腑的协调作用
E. 以上皆是

正确答案：E。以上皆是

解析：脉象的产生，与心脏的搏动、心气的盛衰、脉管的通利和气血盈亏及各脏腑的协调作用直接有关。心是形成脉象的主要动力，气血是形成脉象的基础，脏腑协同是脉象正常的前提（E对）。